木通可应用于
A. 肺热咳嗽、目赤
B. 热疮肿毒、毒蛇咬伤
C. 口舌生疮、心烦尿赤
D. 暑热烦渴
E. 脾虚泄泻

正确答案：C。口舌生疮、心烦尿赤

解析：本题考查的是木通的主治病证。木通可应用于口舌生疮，心烦尿赤（C对）。木通：【主治病证】（1）湿热淋痛，水肿尿少。（2）心火上炎或下移小肠之口舌生疮、心烦尿赤。（3）产后乳汁不通或乳少。（4）湿热痹痛。车前子：【主治病证】（1）湿热淋证，小便不利，水肿兼热。（2）暑湿水泻。（3）肝热目赤肿痛，肝肾亏虚之目暗不明（配补肝肾药）。（4）肺热咳嗽痰多（A错）。金钱草：【主治病证】（1）热淋，石淋。（2）湿热黄疸，肝胆结石。（3）热毒疮肿，毒蛇咬伤（B错）。滑石：【主治病证】（1）湿热淋证，小便不利。（2）暑热烦渴（D错），湿温胸闷，湿热泄泻。（3）湿疮，湿疹，痱子。薏苡仁：【主治病证】（1）小便不利、水肿、脚气肿痛。（2）脾虚泄泻（E错）。（3）湿温病邪在气分。（4）湿痹筋脉拘挛。（5）肺痈，肠痈。